尿培养的球菌菌落计数不低于多少才有诊断意义
A. 100/ml
B. 300/ml
C. 500/ml
D. 1000/ml
E. 10000/ml

正确答案：D。1000/ml

解析：清洁中段尿革兰阴性杆菌定量培养≥100000/ml，如临床上无尿感症状，则要求做两次中段尿培养，格兰阴性杆菌数均为≥100000/ml，且为同一种菌种，称为真性菌尿，可确诊尿路感染；培养10000～100000/ml，位可疑阳性，需复查，如＜10000 /ml，可能为污染。但由球菌的繁殖较杆菌慢，所以尿菌落计数在数值标准要比杆菌少，1000～10000/ml即可确诊（D对）。